氨在肝中合成尿素的主要中间物质
A. 丙氨酸和谷氨酰胺
B. 谷氨酸和丙氨酸
C. 瓜氨酸和精氨酸
D. 半胱氨酸和瓜氨酸
E. 组氨酸和赖氨酸

正确答案：C。瓜氨酸和精氨酸

解析：此题主要考察氨的去路。机体合成尿素的部位为肝脏的线粒体和胞液。代谢途径为鸟氨酸循环，基本步骤为：氨与CO2可在氨基甲酰磷酸合成酶Ⅰ（关键酶）的催化下合成氨基甲酰磷酸，氨基甲酰磷酸与鸟氨酸缩合呈瓜氨酸，瓜氨酸由精氨酸代琥珀酸合成酶（关键酶）催化，与天冬氨酸生成精氨酸代琥珀酸，再裂解成精氨酸和延胡索酸，精氨酸水解生成尿素。综上可知中间产物为瓜氨酸与精氨酸。掌握“氨基酸及氨的代谢”知识点。